龋损及形态与釉柱排列方向一致，即口小底大的三角形潜行性龋损，且很容易进展到牙本质的龋为
A. 平滑面龋
B. 牙颈部龋
C. 窝沟龋
D. 牙本质龋
E. 牙邻面龋

正确答案：C。窝沟龋

解析：窝沟附近的釉柱排列方向为向窝沟底部集中，形成的龋损及形态与釉柱排列方向一致，即口小底大的三角形潜行性龋损，由于釉质在窝沟底较薄，窝沟龋病变很容易进展到牙本质。掌握“牙釉质龋”知识点。